急性牙髓炎的疼痛特点是
A. 自发性痛，热刺激痛加剧，冷刺激痛减轻，疼痛定位，叩诊痛
B. 冷热刺激、疼痛持续时间短暂，无自发痛
C. 自发性、尖锐性疼痛，阵发性发作，冷或热刺激疼痛加强，夜痛明显，牵涉性痛
D. 食物嵌塞疼痛剧烈，温度刺激痛明显，无明显自发痛
E. 持续性钝痛、咬合痛、放射疼

正确答案：C。自发性、尖锐性疼痛，阵发性发作，冷或热刺激疼痛加强，夜痛明显，牵涉性痛

解析：本题考查急性牙髓炎的疼痛特点。急性牙髓炎的疼痛特点是自发性、尖锐性疼痛，阵发性发作，冷或热刺激疼痛加强，夜痛明显，牵涉性痛（C对）。急性牙髓炎是一种发病急疼痛剧烈的不可复性牙髓炎，其疼痛特点：（1）自发性痛（BD错）：在未受到任何外界刺激的情况下，突然发生剧烈的自发性尖锐疼痛。（2）阵发性发作：疼痛可分作持续过程和缓解过程。（3）冷热刺激疼痛加剧（A错）：若患牙处于疼痛发作期内，温度刺激可使疼痛加剧。（4）夜痛明显：疼痛往往在夜间发作，或夜间疼痛较白天剧烈。（5）牵涉性痛：疼痛发作时，患者大多不能明确指出患牙所在，疼痛不能定位（A错）且疼痛呈放散性或牵涉性。常常是沿三叉神经第二支或第三只分布区域放射至患者同侧的上下颌或头面部，但这种放散痛不会发生到患牙的对侧区域。持续性钝痛是慢性牙髓炎的症状，急性牙髓炎呈尖锐疼痛，咬合痛（E错）是根尖周炎或牙周炎的特点。